可与细胞色素氧化酶中的铁结合，阻止酶的递氧作用，导致组织乏氧，使机体陷于窒息状态的是
A. 甲醇
B. 甲醛
C. 铅
D. 锰
E. 氢氰酸

正确答案：E。氢氰酸

解析：本题考查氢氰酸。以木薯或果核为原料制酒时，原料中的氰苷经水解后产生氢氰酸。氢氰酸（E对ABCD错）经胃肠吸收后，氰离子可与细胞色素氧化酶中的铁结合，阻止酶的递氧作用，导致组织缺氧，使机体陷于窒息状态。